何者不是乙脑中枢性呼衰原因
A. 脑组织炎症
B. 脑水肿
C. 脑缺氧
D. 脑性低钠
E. 脑缺血

正确答案：E。脑缺血

解析：乙脑是由乙型脑炎病毒引起的以脑实质炎症为主要病变的中枢神经系统急性传染病，轻者仅出现发热、头痛，重者表现为高热、头痛、呕吐、颈项强直、惊厥、意识障碍、呼吸衰竭。主要为中枢性呼吸衰竭，脑缺血（E错，为本题正确答案）不会造成呼吸衰竭，其原因为脑组织炎症（A对）、脑水肿（B对）、脑缺氧（C对）、颅内高压、脑疝和脑性低钠（D对）等所致，其中以脑实质病变，尤其延髓呼吸中枢病变为主要原因。主要表现为呼吸节律不规则及幅度不均，如呼吸表浅、双吸气、叹息样呼吸、潮式呼吸、抽泣样呼吸等，最后停止呼吸。